患者男性，68岁，胸闷痛反复发作10年，加重1小时，现患者胸闷痛彻背，心慌，大汗出，四肢厥冷，面色唇甲青紫，脉沉微欲绝，应首先考虑的病症是
A. 心绞痛，心肾阳虚证
B. 急性心肌梗死，寒凝心脉证
C. 急性心肌梗死，气阴两虚证
D. 心绞痛，寒凝心脉证
E. 急性心肌梗死，心阳欲绝证

正确答案：E。急性心肌梗死，心阳欲绝证

解析：患者出现胸闷痛彻背，心慌，大汗出，四肢厥冷，面色唇甲青紫，脉沉微欲绝的症状，是由于寒凝心脉，阴损及阳，心气心阳耗损至极，出现了心阳暴脱、阴阳离决之危证，首先考虑的病症结合是急性心肌梗死，心阳欲绝证（E对）。心绞痛，心肾阳虚证为心悸而痛，胸闷气短，甚则胸痛彻背，心悸汗出，畏寒肢冷，下肢浮肿，腰酸无力，面色苍白，唇甲淡白或青紫，舌淡白或紫暗，脉沉细或沉微欲绝（A错）。急性心肌梗死，寒凝心脉证为素体阳虚，胸阳不展，阴寒之邪乘虚侵袭，阴寒凝滞，心阳不振，气血痹阻，遇气候骤冷或感寒使心脉突然闭塞，气血运行中断，发为本病（B错）。急性心肌梗死，气阴两虚证为老体衰或久病者，心气不足，阴血耗伤，气阴亏虚，气血生化不足，亦可导致脉行涩滞，导致血行瘀滞，在诱因作用下，心脉突然闭塞，气血运行中断，发为本病（C错）。心绞痛，寒凝心脉证为猝然胸痛如绞，天冷易发，感寒痛其，形寒，甚则四肢不温。冷汗自出。心悸短气，舌质淡红，苔白，脉沉细或沉紧（D错）。